唐氏综合征患儿染色体核型标准型为
A. 46，XX，-14，+t（14q21q）
B. 47，XX，+21
C. 45，XX，-14，-21，+t（14q21q）
D. 47，XXX
E. 46，XX，-21，+t（2lq21q）

正确答案：B。47，XX，+21

解析：唐氏综合征患儿染色体核型标准型为47，XX，+21（B对）。